具有疏肝行气止痛功用的方剂是
A. 越鞠丸
B. 半夏厚朴汤
C. 厚朴温中汤
D. 旋覆代赭汤
E. 天台乌药散

正确答案：E。天台乌药散

解析：天台乌药散中以乌药为君，其性辛温，可行气疏肝，散寒止痛。配入青皮、小茴香、高良姜、木香等一派辛温芳香之品，助行气散结、祛寒止痛之力，共为臣药。又以槟榔直达下焦，行气化滞而破坚；苦寒之川楝子与辛热之巴豆同炒，去巴豆而用川楝子，既可减川楝子之寒，又能增强其行气散结之效，共为佐使药。诸药共奏行气，散寒，止痛之功（E对），主治肝经气滞寒凝证。越鞠丸可行气（为主）、清热、活血、祛痰湿、消食，主治气、血、痰、火、湿、食六郁之证（A错）。半夏厚朴汤功用为行气散结，降逆化痰，主治梅核气（B错）。厚朴温中汤功用为行气除满，温中燥湿，主治脾胃寒湿气滞证（C错）。旋覆代赭汤功用为降逆化痰，益气和胃，主治胃虚痰阻气逆证（D错）。